早期慢性肾功能不全最主要的治疗目的是
A. 减少蛋白尿
B. 减轻水肿
C. 降低血压
D. 改善营养状况
E. 延缓肾功能减退

正确答案：E。延缓肾功能减退

解析：早期慢性肾功能不全最主要的治疗目的是延缓肾功能减退（E对），改善或缓解临床症状，防治严重并发症的发生，具体措施包括减少蛋白尿（A错）、减轻水肿（B错）、降低血压（C错）、改善营养状况（D错）、纠正酸中毒和电解质紊乱、防止感染、纠正高脂血症等。